《素问·阴阳应象大论》指出，其实者
A. 因而越之
B. 泻之于内
C. 散而泻之
D. 按而收之
E. 引而竭之

正确答案：C。散而泻之

解析：“其实者，散而泻之“”意为邪气盛实者，区别邪之阴阳，用散邪的办法或泄泻之法治疗（C对）。“其高者，因而越之（A错）。中满者，泻之于内（B错）。其慓悍者。按而收之（D错）。其在下者，引而竭之（E错）。”